男，78，右下肢行走痛，乏力5年，加重1年，既往高血压10年，糖尿病5年，查体：右足背，腘动脉消失，右股动脉正常，右下肢皮温下降，右足苍白。患者考虑为
A. 血栓闭塞性脉管炎
B. 急性动脉栓塞
C. 动脉硬化性闭塞症
D. 下肢深静脉血栓
E. 血栓性浅静脉炎

正确答案：C。动脉硬化性闭塞症

解析：该患者，男，78岁，出现右下肢行走痛，乏力5年，加重1年，既往高血压10年，糖尿病5年，查体：右足背，腘动脉消失，右股动脉正常，右下肢皮温下降，右足苍白，结合患者的病史，表现和查体，考虑为动脉硬化性闭塞症（C对）。